判断某人是否已感染了HBV最直接、最敏感的指标和检测方法为
A. HBV DNA，PCR法
B. HBsAg，RPHA法
C. HBsAg，RIA法
D. HBsAg，ELISA法
E. HBV DNA，分子杂交法

正确答案：A。HBV DNA，PCR法

解析：本题考查HBV的检测指标。判断某人是否已感染了HBV最直接、最敏感的指标和检测方法为HBV DNA，PCR法（A对BCDE错）。